对毒性药品的规定，正确的有
A. 医疗单位供应和调配毒性药品，凭医师签名的正式处方
B. 零售药店供应和调配毒性药品，凭盖有医师所在医疗单位公章的正式处方
C. 所有毒性药品的处方，每次剂量都不得超过3日极量
D. 医疗机构购入西药毒性药品，仅作为制剂原料使用
E. 医师开写毒性药品处方，可以开制剂，也可以开少量的原料药

正确答案：A、B、D。医疗单位供应和调配毒性药品，凭医师签名的正式处方；零售药店供应和调配毒性药品，凭盖有医师所在医疗单位公章的正式处方；医疗机构购入西药毒性药品，仅作为制剂原料使用